男，20岁，8月5日来诊。进食海鲜3小时后出现腹泻，呕吐伴轻微腹痛，大便为稀水样，共便20次。查体：烦躁不安，脱水貌，双侧腓肠肌痉挛。粪常规可见少量白细胞，未见红细胞。该患最适合的治疗措施是
A. 静脉点滴抗生素
B. 静脉点滴碳酸氢钠
C. 静脉补充电解质和液体
D. 口服补液盐
E. 口服止泻药

正确答案：C。静脉补充电解质和液体

解析：由于霍乱腹泻严重，造成大量体液丢失，患者已烦躁不安，有精神神经症状，因此该患者最适合的治疗措施是静脉补充电解质和液体（C对）。抗菌治疗仅作为液体疗法的辅助治疗（A错）。本病的补液治疗一般多采用与患者丢失的电解质溶液相近的541液，只补充碳酸氢钠（B错）并不能维持人体正常电解质和酸碱平衡。口服补液盐（D错）适用于轻症脱水。腹泻会有一部分排菌的作用，腹泻后不能盲目止泻，应以补液为主而不是口服止泻药（E错）。